下列会影响崩解度的有
A. 黏合剂用量不足或黏性不够
B. 压片时压力过大
C. A和B均是
D. A和B均不是

正确答案：C。A和B均是

解析：本题考查片剂制备中的常见问题及原因。黏合剂用量不足或黏性不够、压片时压力过大（C对）都会影响崩解度。影响崩解的主要原因有：①片剂的压力过大，导致内部空隙小，影响水分渗入；②增塑性物料或黏合剂使片剂的结合力过强；③崩解剂性能较差。